内毒素
A. 作用于体温调节中枢，使体温调定点上移
B. 作用于体温调节中枢，使EP产生和释放
C. 作用于产致热原细胞，使体温调定点上移
D. 作用于产致热原细胞，使EP产生和释放
E. 作用于体温调节中枢和产致热原细胞，使体温调定点上移

正确答案：D。作用于产致热原细胞，使EP产生和释放

解析：内毒素属于外致热原，通过作用于产致热原细胞，刺激EP的产生和释放（D对），从而使体温升高。